香豆素类药物的作用机制是
A. 加速凝血因子Ⅱa的灭活
B. 激活抗凝血酶Ⅲ
C. 拮抗维生素K的作用
D. 加速凝血因子Ⅶa、Ⅸa的灭活
E. 加速凝血因子Ⅹa、Ⅻa的灭活

正确答案：C。拮抗维生素K的作用

解析：香豆素类药物为维生素K的拮抗剂，能抑制肝脏的维生素K环氧还原酶，阻止维生素K（C对）的环氧型向氢醌型的转变，从而阻止维生素K的再利用，影响凝血因子Ⅱ、Ⅶ、Ⅸ、Ⅹ的γ羧化，阻止了其活化，产生抗凝作用。肝素带有负电荷可与带正电荷的ATⅢ的赖氨酸残基形成可逆复合物，使ATⅢ暴露活性中心，加速ATⅢ对凝血因子Ⅱa、Ⅸa、Ⅹa、Ⅺa和Ⅻa（ADE错）等的灭活，产生强大的抗凝作用。肝素能够激活抗凝血酶Ⅲ（B错）的活性，还能抑制凝血酶原的激活，抑制血小板黏附、聚集和释放。